肝硬化的特征性病变是
A. 肝细胞增生
B. 小胆管增生
C. 纤维组织增生
D. 肝细胞变性
E. 假小叶形成

正确答案：E。假小叶形成

解析：肝硬化时的特征性病变是，由广泛增生的纤维组织分割原来的肝小叶并包绕成大小不等的肝细胞团，即假小叶的形成（E对）。肝细胞增生（A错）、小胆管增生（B错）、纤维组织增生（C错）、肝细胞变性（D错）均为肝硬化的病理改变，但不具有特征性。